心血管疾病的干预对象为
A. 中老年人
B. 儿童
C. 妇女
D. 所有人群
E. 高危人群

正确答案：A。中老年人